通过激动β₂受体发挥平喘作用的药物是
A. 氨茶碱
B. 沙丁胺醇
C. 异丙阿托品
D. 色甘酸钠
E. 二丙酸倍氯米松

正确答案：B。沙丁胺醇

解析：本题考查沙丁胺醇。通过激动β₂受体发挥平喘作用的药物是沙丁胺醇（B对）。沙丁胺醇选择性地兴奋β₂受体，扩张支气管，解除支气管痉挛。用于治疗支气管哮喘或喘息性慢性支气管炎伴支气管痉挛。氨茶碱（A错）为非特异性磷酸二酯酶（PDE）抑制剂，主要通过抑制PDE₃、PDE₄和PDE₅，使细胞内cAMP和cGMP水平升高，松弛支气管平滑肌。异丙阿托品（C错）是一种对支气管平滑肌有较高选择性的强效抗胆碱药，对松弛支气管平滑肌作用较强。主要适用于可逆性支气管痉挛如支气管哮喘、伴发肺气肿的慢性支气管炎，尤其适用于因用β受体激动剂产生肌肉震颤、心动过速而不能耐受此类药物的病人。色甘酸钠（D错）为肥大细胞膜稳定剂，稳定肺组织肥大细胞膜，抑制过敏介质释放。此外，尚可阻断引起支气管痉挛的神经反射，降低哮喘患者的气道反应性。二丙酸倍氯米松（E错）为吸入型肾上腺糖皮质激素，通过抑制气道炎症反应，达到长期防止哮喘发作的效果。